腮腺区包块通常不作术前病理检查，而采取手术时作冰冻检查的主要原因是
A. 重复切口影响美观
B. 患者免受两次手术痛苦
C. 增加解剖面神经的困难，并且不符合肿瘤治疗原则
D. 有面神经不易取标本
E. 增加刀口感染机会

正确答案：C。增加解剖面神经的困难，并且不符合肿瘤治疗原则

解析：腮腺区包块通常不作术前病理检查，而采取手术时作冰冻检查的主要原因是增加解剖面神经的困难，并且不符合肿瘤治疗原则（C对）。腮腺区包块应引起足够的重视，否则可能由于逐渐增大而压迫神经引起相应症状，或由于炎症扩散引起相邻组织间隙感染，甚至可能导致腮腺功能丧失，病程较长者会影响治疗效果提高根治难度且易复发，故在发现腮腺包块时应及时诊治，以预防其并发症和后遗症。术前病理检查容易造成细胞扩散、种植，且会形成不易愈合的涎瘘，术区组织完整性的破坏，一方面增加了解剖面神经的难度，另一方面也不符合肿瘤的尽量预防病灶转移的治疗原则。若在术前对腮腺区包块作术前病理检查，虽然患者的重复刀口影响美观（A错）、两次手术患者感觉痛苦（B错）、面神经穿行其中不易取标本（D错）、以及增加了刀口感染机会（E错），况且若采用细针活吸的手段，对美观几乎无影响，但这些都不是问题的根本所在，主要原因是防止增加解剖面神经的困难，并且不符合肿瘤治疗原则。